男，20岁，发热2天，加重7h，查体：血压150/100mmhg，尿常规：尿蛋白3+，红细胞满视野。肾脏活检免疫荧光见以IgA为主的颗粒状沉积于系膜区及毛细血管袢。以下选项中与预后无关的是
A. 高血压
B. 蛋白尿
C. 镜下血尿
D. 病理活检
E. 血肌酐

正确答案：C。镜下血尿

解析：该患者男，20岁，出现发热2天，加重7h，查体：血压150/100mmhg，尿常规：尿蛋白3+，红细胞满视野。肾脏活检免疫荧光见以IgA为主的颗粒状沉积于系膜区及毛细血管袢，结合患者的表现和辅助检查，提示为IgA肾病，影响预后的不良指标有持续难以控制的高血压和蛋白尿（尤其是蛋白尿持续>lg/d)；肾功能损害；肾活检病理表现为肾小球硬化、间质纤维化和肾小管萎缩，或伴大量新月体形成（C错为本题正确答案）。